表面黄棕色至黑褐色，密被排列整齐叶柄残基及鳞片的药材是
A. 何首乌
B. 绵马贯众
C. 石菖蒲
D. 骨碎补
E. 天南星

正确答案：B。绵马贯众

解析：本题考查的是绵马贯众药材的性状鉴别。表面黄棕色至黑褐色，密被排列整齐叶柄残基及鳞片的药材是绵马贯众（B对）。绵马贯众：【性状鉴别】药材呈长倒卵形，略弯曲，上端钝圆或截形，下端较尖，有的纵剖为两半。表面黄棕色至黑褐色，密被排列整齐的叶柄残基及鳞片，并有弯曲的须根。叶柄残基呈扁圆形；表面有纵棱线，质硬而脆，断面略平坦，棕色，有黄白色维管束5～13个，环列；每个叶柄残基的外侧常有3条须根，鳞片条状披针形，全缘，常脱落。质坚硬，断面略平坦，深绿色至棕色，有黄白色维管束5～13个，环列，其外散有较多的叶迹维管束。气特异，味初淡而微涩，后渐苦、辛。何首乌（A错）：【性状鉴别】药材呈团块状或不规则纺锤形。表面红棕色或红褐色，皱缩不平，有浅沟，并有横长皮孔样突起及细根痕。体重，质坚实，不易折断，切断面浅黄棕色或浅红棕色，显粉性，皮部有4～11个类圆形异型维管束环列，形成云锦状花纹，中央木部较大，有的呈木心。气微，味微苦而甘涩。石菖蒲（C错）：【性状鉴别】药材呈扁圆柱形，多弯曲，常有分枝。表面棕褐色或灰棕色，粗糙，有疏密不匀的环节，具细纵纹，一面残留须根或圆点状根痕；叶痕呈三角形，左右交互排列，有的其上有鳞毛状的叶基残余。质硬，断面纤维性，类白色或微红色，内皮层环纹明显，并可见多数维管束小点及棕色油点。气芳香，味苦、微辛。天南星（E错）：【性状鉴别】药材呈扁球形。表面类白色或淡棕色，较光滑，顶端有凹陷的茎痕，周围有麻点状根痕，有的块茎周边具小扁球状侧芽。质坚硬，不易破碎，断面不平坦，色白，粉性。气微辛，味麻辣。骨碎补（D错）药材的性状鉴别，2022年考试指南未明确说明。骨碎补：【性状鉴别】药材呈扁平长条状，多弯曲，有分枝。表面密被深棕色至暗棕色小鳞片，柔软如毛，经火燎者呈棕褐色或暗褐色，两侧及上表面均具凸起或凹下的圆形叶痕，少数有叶柄残基及须根残留。体轻，质脆，易折断，断面红棕色，维管束呈黄色点状，排列成环。无臭，味淡，微涩。